药品说明书必须提供的基本信息是药品的
A. 合法性
B. 相容性
C. 相关性
D. 安全性
E. 稳定性

正确答案：D。安全性